根据《中药品种保护条例》，可以申请二级保护但不能申请一级保护的中药品种是
A. 从天然药物中提取的
B. 医疗用毒性中药饮片
C. 相当于国家一级保护野生药材物种的人工制成品
D. 国家重点保护野生药材

正确答案：A。从天然药物中提取的

解析：本题考查中药保护品种的等级划分。根据《中药品种保护条例》，可以申请二级保护但不能申请一级保护的中药品种是从天然药物中提取的（A对）。中药保护品种的等级划分：对受保护的中药品种分为一级和二级进行管理。中药一级保护品种的保护期限分别为30年、20年、10年，中药二级保护品种的保护期限为7年。（1）申请中药一级保护品种应具备的条件：符合下列条件之一的中药品种，可以申请一级保护。①对特定疾病有特殊疗效的；②相当于国家一级保护野生药材物种的人工制成品（C错）；③用于预防和治疗特殊疾病的。（2）申请中药二级保护品种应具备的条件：符合下列条件之一的中药品种，可以申请二级保护。①符合上述一级保护的品种或者已经解除一级保护的品种；②对特定疾病有显著疗效的；③从天然药物中提取的有效物质及特殊制剂。医疗用毒性中药品种（B错）共27种：砒石（红砒、白砒）、砒霜、水银、生马钱子、生川乌、生草乌、生白附子、生附子、生半夏、生南星、生巴豆、斑蝥、青娘虫、红娘子、生甘遂、生狼毒、生藤黄、生千金子、生天仙子、闹羊花、雪上一枝蒿、白降丹、蟾酥、洋金花、红粉、轻粉、雄黄。需要说明的是上述中药品种是指原药材和饮片，不含制剂。国家重点保护野生药材（D错）物种的分级：国家重点保护的野生药材物种分为三级管理。一级保护野生药材物种：系指濒临灭绝状态的稀有珍贵野生药材物种。二级保护野生药材物种：系指分布区域缩小，资源处于衰竭状态的重要野生药材物种。三级保护野生药材物种：系指资源严重减少的主要常用野生药材物种。